树脂充填时制备（牙合）面洞时，洞缘应成
A. 直角
B. 45度斜面
C. 锐角
D. 60度斜面

正确答案：B。45度斜面

解析：本题考查树脂充填的洞缘预备。为了使复合树脂更好的与牙体组织结构的颜色交织，在欲进行树脂充填的窝洞制备时，洞缘应成45度斜面（B对），但洞缘位置应避开咬合接触点。银汞合金脆性强在（牙合）力作用下易折裂，不能制备洞缘斜面，一般洞缘为直角（A错）。洞缘制成锐角，会形成无基釉，在承受咬合力时易折裂（C错）。洞缘制成60度斜面，增大了洞缘的外展度，不利于充填体固位，且去除的健康牙体组织多，不利于剩余牙体组织的抗力（D错）。